男婴，10个月。经常出现夜惊，近1周加重，多汗，烦躁，该患儿生后一直混合喂养，未添加辅食。此次患儿体格检查最可能发现的阳性体征为
A. 方颅，乳牙未萌出
B. 皮下脂肪明显减少
C. 面色苍白
D. 肌张力增高
E. 皮肤弹性差

正确答案：A。方颅，乳牙未萌出

解析：男婴，10个月。经常出现夜惊，近1周加重，多汗，烦躁，该患儿生后一直混合喂养，未添加辅食（4～６个月开始应该添加辅食），营养性维生素Ｄ缺乏，可引起方颅，乳牙萌出推迟（A对）等。